炮制后酸寒之性降低善于调经止血、柔肝止痛，主治肝郁血虚、胁痛腹痛、月经不调、四肢挛痛的饮片是
A. 酒白芍
B. 米炒白芍
C. 炒白芍
D. 土炒白芍
E. 醋白芍

正确答案：A。酒白芍

解析：本题考查的是白芍的炮制作用。炮制后酸寒之性降低善于调经止血、柔肝止痛，主治肝郁血虚、胁痛腹痛、月经不调、四肢挛痛的饮片是酒白芍（A对）。白芍：【炮制作用】白芍味苦、酸，性微寒。归肝、脾经。具有泻肝火，平抑肝阳，养阴除烦的功能。多用于肝阳上亢，头痛，眩晕，耳鸣，阴虚发热，烦躁易怒。①炒白芍（C错），寒性缓和，以养血和营，敛阴止汗为主。用于血虚萎黄，腹痛泄泻，自汗盗汗。②酒白芍，酸寒伐肝之性降低，入血分，善于调经止血，柔肝止痛，用于肝郁血虚，胁痛腹痛，月经不调，四肢挛痛。③醋白芍（E错），引药入肝，敛血养血、疏肝解郁的作用最强。④土炒白芍（D错）可借土气入脾，增强养血和脾、止泻作用，适用于肝旺脾虚，腹痛腹泻。米炒白芍（B错）的作用，2022年考试指南未明确说明。